预防脊髓灰质炎疫苗初种年龄
A. 生后2～3天到2个月之内
B. 2个月以上
C. 9个月以上易感儿
D. 3个月以上小儿
E. 1岁以上

正确答案：B。2个月以上

解析：本题考查预防脊髓灰质炎疫苗的初种年龄。新生儿从母体获得脊髓灰质炎被动免疫抗体的量极微，婴儿早期容易发病，而且威胁较大。我国规定分别于生后2月龄（B对ACDE错）开始接种脊髓灰质炎疫苗。